下列有关恒尖牙萌出的说法正确的有
A. 最常见的是下颌尖牙的唇侧异位萌出
B. 恒尖牙异位萌出的位置多变
C. 第一乳磨牙的根尖周病不会影响恒尖牙的正常萌出
D. 以上都不对
E. 以上都对

正确答案：B。恒尖牙异位萌出的位置多变

解析：本题考查牙齿异位萌出。牙齿异位萌出是指恒牙在萌出过程中未在牙列的正常位置萌出。牙齿的异位萌出多发生在上颌尖牙和上颌第一恒磨牙，其次是下颌侧切牙和第一恒磨牙。恒尖牙的异位萌的位置多变（B对），可分为唇向异位和腭向异位。最常见的是上颌尖牙的唇侧异位萌出（A错）。恒尖牙唇侧异位萌出，多由于乳尖牙早失，第一前磨牙萌出后近中移位，导致恒尖牙的萌出位置变窄。尖牙易唇侧异位萌出，由于上颌尖牙咬合时受唇向力，下尖牙受舌向力，所以最常见的是上颌尖牙的唇侧异位萌出。乳牙根尖周病，会使其继发恒牙的牙胚，影响正常萌出，而恒尖牙距离第一乳磨牙距离较近，第一乳磨牙的根尖周病也会影响恒尖牙的正常萌出（C错）。